龈下边缘不适用于
A. 金瓷冠的唇侧边缘
B. 牙冠短者
C. 缺损至龈下
D. 牙体较小者
E. 龈沟浅者

正确答案：E。龈沟浅者

解析：本题考查修复体试戴、磨光与粘固。龈下边缘对牙周有一定的刺激，不适用于龈沟浅者（E错，为本题正确答案）。龈沟浅者易损伤结合上皮。